可进一步分化为成牙本质细胞的结构是
A. 牙板
B. 成釉器
C. 牙囊
D. 牙乳头
E. 前庭板

正确答案：D。牙乳头

解析：本题考查牙乳头。可进一步分化为成牙本质细胞的结构是牙乳头（D对）。牙乳头可分化形成成牙本质细胞和星形纤维细胞。在胚胎第7周，原发性上皮带向颊侧（唇）侧方向生长的上皮板称为前庭板，位于舌（腭）侧的上皮板称为牙板。前庭板（E错）向深层增生，同时表面上皮变性脱落，形成前庭沟。牙板局部增生上皮和间充质共同组成牙胚，包括成釉器、牙乳头、牙囊（A错）。成釉器可分化成为内釉上皮层、外釉上皮层和星网状层、中间层（B错）。牙囊细胞分化成牙骨质细胞、成骨细胞（C错）。